给药方式有首关清除，正确的是
A. 口服
B. 舌下
C. 直肠
D. 静脉
E. 肌肉

正确答案：A。口服